药品经营企业发现其经营的药品存在较大安全隐患，应当采取的措施不包括
A. 采取紧急控制措施销毀有安全隐患的药品
B. 立即停止销售
C. 通知药品生产企业或者供货商
D. 向药品监督管理部门报告

正确答案：A。采取紧急控制措施销毀有安全隐患的药品

解析：本题考查的是销售与使用单位在药品召回的职责。药品经营企业发现其经营的药品存在较大安全隐患，应当采取的措施不包括采取紧急控制措施销毀有安全隐患的药品（A错，为本题正确答案）。销售与使用单位在药品召回的职责：药品经营企业、使用单位发现其经营、使用的药品存在安全隐患的，应当立即停止销售（B对）或者使用该药品，通知药品生产企业或者供货商（C对），并向药品监督管理部门报告（D对）。药品经营企业和使用单位应当建立和保存完整的购销记录，保证销售药品的可溯源性。在药品生产实施药品召回时，药品经营企业、使用单位应当协助药品生产企业履行召回义务，按照召回计划的要求及时传达、反馈药品召回信息，控制和收回存在安全隐患的药品。